以下哪项不属于胆碱能系统结合相应递质后产生的作用
A. 心肌收缩力减弱
B. 冠状血管舒张
C. 皮肤黏膜血管舒张
D. 唾液腺血管收缩
E. 支气管平滑肌收缩

正确答案：D。唾液腺血管收缩